全冠修复不可能对牙龈造成危害的因素是
A. 牙体预备
B. 取印模
C. 轴面外形
D. 邻接触
E. 调改对颌牙

正确答案：E。调改对颌牙

解析：本题考查全冠修复时对牙龈造成危害的因素。调改对颌牙（E错，为本题的正确答案）是对牙齿（牙合）面的磨改，是不可能对牙龈造成危害的。全冠修复的过程中，涉及到牙体预备、调改对颌牙、取模、戴冠等好多方面。在牙体预备（A对）中，制作肩台、调节轴面外形（C对）、磨开邻面接触预备邻面（D对）的过程中会因为支点不稳、没有排龈、患者突然移动等原因对牙龈造成危害。取印模（B对）的时候用力过大压迫牙龈也会对其造成危害。